环烯醚萜的结构特点
A. 半缩醛结构
B. 烯醚环戊烷结构
C. 醌烯结构
D. 蒽酮结构
E. 蒽酚结构

正确答案：A、B。半缩醛结构；烯醚环戊烷结构

解析：本题考查的是环烯醚萜的结构。环烯醚萜的结构特点是半缩醛结构（A对）与烯醚环戊烷结构（B对）。环烯醚萜类的基本母核为环烯醚萜醇，具有半缩醛及环戊烷环的结构特点，其半缩醛1位羟基性质不稳定，故环烯醚萜类化合物主要以1位羟基与糖成苷的形式存在于植物体内。根据其环戊烷环是否裂环，可将环烯醚萜类化合物分为环烯醚萜苷及裂环环烯醚萜苷两大类。蒽酮结构（D错）和蒽酚结构（E错）属于蒽醌类化合物中。蒽醌类成分包括蒽酮及其不同还原程度的产物。按母核可分为单蒽核及双蒽核，按氧化程度又可分为氧化蒽酚、蒽酮、蒽酚及蒽酮的二聚物。醌烯结构（C错），2022年考试指南未明确说明。